因残根，残冠的尖锐边缘刺激造成的相对应的黏膜形成的溃疡，称为
A. Bednar溃疡
B. Riga-Fede溃疡
C. 腺周口疮
D. 创伤性溃疡
E. 结核性溃疡

正确答案：D。创伤性溃疡

解析：本题考查创伤性溃疡的临床表现。因残根，残冠的尖锐边缘刺激造成的相对应的黏膜形成的溃疡，称为创伤性溃疡（D对）。Bednar溃疡由婴儿吮吸拇指或过硬的橡皮奶头引起，固定发生于硬腭、双侧翼钩处黏膜表面，双侧对称性分布（A错）；Riga-Fede溃疡专指发生于儿童舌腹的溃疡（B错）；腺周口疮即重型复发性阿弗他溃疡，好发于口角（C错）；创伤性溃疡为压疮性溃疡、Bednar溃疡、Riga-Fede溃疡、自伤性溃疡、化学灼伤性溃疡、热灼伤性溃疡的总称，压疮性溃疡由持久的非自伤性机械性刺激造成；口腔中常见继发性结核损害是结核性溃疡（E错），好发于舌部。